调剂科（室）的基本工作制度有
A. 查对制度
B. 不良反应报告制度
C. 岗位责任制度
D. 差错登记制度
E. 交接班制度

正确答案：A、B、C、D、E。查对制度；不良反应报告制度；岗位责任制度；差错登记制度；交接班制度